呼吸性碱中毒合并AG增高性代谢性酸中毒和代谢性碱中毒的特点是
A. PaCO₂降低
B. AG>16mmol/L
C. HCO₃⁻可高可低
D. Cl⁻一般低于正常
E. 以上都是

正确答案：E。以上都是

解析：呼吸性碱中毒合并AG增高性代谢性酸中毒和代谢性碱中毒的特点是PaCO ₂降低（A对），AG>l6mmol/L（B对）, HCO ₃⁻可高可低（C对），Cl⁻一般低于正常（D对，故E为本题正确答案）。